哪个牙的根尖1/3偏唇侧，并略偏远中
A. 上颌乳尖牙
B. 下颌乳尖牙
C. 上颌乳中切牙
D. 上颌第二乳磨牙
E. 下颌第一乳磨牙

正确答案：C。上颌乳中切牙

解析：上颌乳中切牙牙根为宽扁单根，唇面较舌面为宽，根长约为冠长的2倍。根尖1/3偏唇侧，并略偏远中。宽冠宽根为该牙的重要解剖特征。掌握“上下颌前牙的外形及临床应用解剖”知识点。